NOAEL指的是
A. 未观察到有害作用水平
B. 观察到有害作用的最低水平
C. 观察到作用的最低水平
D. 阈值

正确答案：A。未观察到有害作用水平

解析：本题考查NOAEL。NOAEL即未观察到有害作用的水平，是指在规定的暴露条件下，外源化学物不引起机体（人或实验动物）可检测到的有害作用的最高剂量或浓度。